乳腺癌CMF化疗方案的药物是
A. 长春新碱、甲氨蝶呤、氟尿嘧啶
B. 环磷酰胺、阿霉素、氟尿嘧啶
C. 环磷酰胺、甲氨蝶呤、氟尿嘧啶
D. 长春新碱、阿霉素、氟尿嘧啶
E. 长春新碱、环磷酰胺、氟尿嘧啶

正确答案：C。环磷酰胺、甲氨蝶呤、氟尿嘧啶